肺泡Ⅱ型上皮细胞分泌
A. 肺泡表而活性物质
B. 肺泡表面液体薄层
C. 肺泡上皮细胞
D. 间质
E. 毛细血管基膜和内皮细胞

正确答案：A。肺泡表而活性物质